《中国药典》规定，应进行膨胀度测定的中药有
A. 葶苈子
B. 哈蟆油
C. 决明子
D. 地肤子
E. 车前子

正确答案：A、B、E。葶苈子；哈蟆油；车前子

解析：本题考查的是药材的一般理化鉴别。《中国药典》规定，应进行膨胀度测定的中药有葶苈子（A对）、蛤蟆油（B对）与车前子（E对）。药材的膨胀度测定：膨胀度是药品膨胀性质的指标，是指每1g药品在水或其他规定的溶剂中，在一定的时间与温度条件下膨胀后所占有的体积（ml）。主要用于含黏液质、胶质和半纤维素类的天然药品。《中国药典》规定，车前子膨胀度不低于4.0；蛤蟆油膨胀度不低于55；南葶苈子膨胀度不低于3，北葶苈子膨胀度不低于12。决明子（C错）：【性状鉴别】药材决明略呈菱状方形或短圆柱形，两端平行倾斜。表面绿棕色或暗棕色，平滑有光泽。一端较平坦、另端斜尖，背腹面各有1条突起的棱线，棱线两侧各有1条斜向对称而色较浅的线形凹纹。质坚硬，不易破碎。种皮薄，子叶2，黄色，呈“S”形折曲并重叠。气微，味微苦。地肤子（D错）：【性状鉴别】药材呈扁球状五角星形。外被宿存花被，表面灰绿色或浅棕色，周围具膜质小翅5枚，背面中心有微突起的点状果梗痕及放射状脉纹5～10条；剥离花被，可见膜质果皮，半透明。种子扁卵形，黑色。气微，味微苦。